1994年，某地农村产妇分娩一女婴。由于第三产程子宫收缩无力，产妇的胎盘迟迟未娩出。此时，无证个体医王某，在一不消毒，二不戴消毒手套的情况下，将手伸进子宫，误认为还有一胎儿未娩出而向外猛拉子宫，当场造成产妇大出血死亡。根据《执业医师法》的规定，应依照该法追究王某的法律责任，其法律责任不包括
A. 责令改正
B. 予以取缔
C. 没收违法所得及其药品器械
D. 赔偿责任
E. 刑事责任

正确答案：A。责令改正

解析：该无证个体医王某，未取得医师资格而从事医疗活动，属于非医师行医。由于操作不当，造成产妇大出血死亡，已构成犯罪。根据《执业医师法》的规定，非医师行医的，应由县级以上人民政府卫生行政部门予以取缔（B对），没收其违法所得及其药品器械（C对），并处10万元以下的罚款；对医师吊销其执业证书；给患者造成损害的，依法承担赔偿责任（D对）；构成犯罪的，依法追究刑事责任（E对）（A错，为本题正确答案）。